某女，58岁，半年来，面色苍白，气短心悸，头晕自汗，体倦乏力，四肢不温。证属气血两虚。治当温补气血，宜选用的成药是
A. 十全大补丸
B. 人参归脾丸
C. 人参固本丸
D. 桂附地黄丸
E. 七宝美髯丹

正确答案：A。十全大补丸

解析：本题考查的是十全大补丸的功能。半年来，面色苍白，气短心悸，头晕自汗，体倦乏力，四肢不温。证属气血两虚。治当温补气血，宜选用的成药是十全大补丸（A对）。十全大补丸：【功能】温补气血。人参归脾丸（B错）：【功能】益气补血，健脾宁心。人参固本丸（C错）：【功能】滋阴益气，固本培元。桂附地黄丸（D错）：【功能】温补肾阳。七宝美髯丸（E错）：【功能】滋补肝肾。